苯丙酮尿症的遗传形式为
A. 常染色体显性遗传
B. 常染色体隐性遗传
C. X连锁显性遗传
D. X连锁隐性遗传
E. X连锁不完全显性遗传

正确答案：B。常染色体隐性遗传

解析：苯丙酮尿症是一种常染色体隐性遗传疾病，该苯丙氨酸羟化酶突变的基因位于12号染色体上（B对）。